桑叶除疏散风热、清肺润燥外，又能
A. 凉血止血
B. 息风止痉
C. 升阳止泻
D. 祛风止痛
E. 疏肝透疹

正确答案：A。凉血止血

解析：本题考查的是桑叶的功效。桑叶除疏散风热、清肺润燥外，又能凉血止血（A对）。桑叶：【功效】疏散风热，清肺润燥，平肝明目，凉血止血。蝉蜕：【功效】疏散风热，透疹止痒，明目退翳，息风止痉（B错）。葛根：【功效】解肌退热，透疹，生津，升阳止泻（C错）。蔓荆子：【功效】疏散风热，清利头目，祛风止痛（D错）。薄荷：【功效】宣散风热，清利头目，利咽，透疹，疏肝（E错）。